蓝斑-去甲肾上腺素能神经元的中枢位点是
A. 肾上腺髓质
B. 蓝斑
C. 腺垂体
D. 大脑边缘系统
E. 室旁核

正确答案：B。蓝斑

解析：蓝斑（B对）是蓝斑-去甲肾上腺素能神经元／交感-肾上腺髓质系统的中枢位点。